治疗青光眼可选用
A. 呋塞米
B. 乙酰唑胺
C. 氢氯噻嗪
D. 螺内酯
E. 氨苯蝶啶

正确答案：B。乙酰唑胺

解析：本题考查利尿药的临床作用。治疗青光眼可选用乙酰唑胺（B对）。乙酰唑胺为碳酸酐酶抑制剂，由于利尿作用弱，目前很少用于利尿。主要用于治疗青光眼和脑水肿。呋塞米（A错）属于袢利尿剂，可用于消除各种严重的水肿、治疗急性肺水肿和脑水肿、预防急性肾衰竭、加速中毒药物排泄。氢氯噻嗪（C错）为中效利尿剂，临床用于水肿、高血压及尿崩症的治疗。螺内酯（D错）为醛固酮受体阻断剂，主要用于伴有醛固酮升高的顽固性水肿，如充血性心力衰竭、肝硬化腹水及肾病综合征。氨苯蝶啶（E错）为肾小管上皮细胞Na⁺通道阻滞剂，在临床上用于治疗各种水肿，常与排钾利尿药合用治疗顽固性水肿。